尿血与血淋的鉴别，主要在于
A. 尿色的深浅
B. 尿量的多少
C. 尿味的情况
D. 有无尿痛
E. 以上均非

正确答案：D。有无尿痛

解析：淋证血淋常与尿血相鉴别。两者均为血随尿出，甚至溺出纯血的症状，但尿血多无疼痛之感，或有轻微的胀痛或热痛，但终不若血淋的小便淋漓而疼痛难忍，发热、腹痛、排尿困难、出血量的多少不作为鉴别两者的主要症状（D对）（ABCE错）。